调查研究和实验研究最主要的区别在于是否
A. 随机
B. 重复
C. 施加处理因素
D. 设置对照
E. 分布均衡

正确答案：C。施加处理因素